对股骨头缺血性坏死早期诊断最有价值的是
A. B超
B. 临床症状和体征
C. X线片
D. CT
E. MRI

正确答案：E。MRI

解析：对股骨头缺血性坏死早期诊断最有价值的是MRI（E对）。MRI在股骨头缺血坏死早期便可发现骨质的改变，股骨头前上部在T1WI呈条带状低信号，在T2WI显示出典型的双线征。X线（C错）也是股骨头坏死诊断的重要手段，股骨头血液供应中断后12小时骨细胞便可出现坏死，但是在X线片上看股骨头密度改变至少需要8周或更长的时间，故不作为早期股骨头坏死最敏感的诊断手段。CT（D错）虽然显示骨坏死较X线敏感，但不如MRI敏感。B超（A错）无法穿透成人皮质骨，故难于诊断骨骼疾病。股骨头坏死早期的临床症状和体征（B错）不典型，对其诊断价值不大。